汉防己除祛风除湿、止痛外，又能
A. 降血压
B. 杀虫解毒
C. 强筋健骨
D. 利水消肿
E. 定惊止痉

正确答案：D。利水消肿

解析：本题考查的是防己的功效。汉防己除祛风除湿、止痛外，又能利水消肿（D对）。防己习称汉防己。防己：【功效】祛风湿，止痛，利水。臭梧桐：【功效】祛风湿，通经络，降血压（A错）。雷公藤：【功效】祛风除湿，活血通络，消肿止痛，杀虫解毒（B错）。仙茅：【功效】补肾壮阳，强筋健骨（C错），祛寒除湿。蕲蛇：【功效】祛风通络，定惊止痉（E错）。